尿血，面色苍白，倦怠乏力，自汗，盗汗，舌质淡，苔薄白，脉沉细无力。其证型是
A. 肝郁气滞
B. 湿热下注
C. 气血两虚
D. 瘀血内阻
E. 脾肾两虚

正确答案：C。气血两虚

解析：患者面色苍白，盗汗，提示血虚。伴自汗、倦怠乏力提示气虚不固。舌脉亦支持气血两虚，故此病例可诊断为气血两虚（C对）。膀胱癌肝郁气滞（A错）证见尿血，胁痛，口苦咽干，烦躁易怒。舌质红，苔薄黄，脉弦。膀胱癌湿热下注（B错）证见尿血，尿频数，尿痛，小腹胀痛，口渴不欲饮。舌质红，苔黄腻，脉滑数。膀胱癌无瘀血内阻（D错）、脾肾两虚（E错）这两个证型。